医疗机构工作人员上岗工作。必须佩带
A. 载有本人姓名、性别和年龄的标牌
B. 载有本人姓名、性别和专业的标牌
C. 载有本人姓名、专业和职务的标牌
D. 载有本人姓名、职务或者职称的标牌
E. 载有本人姓名、职称及科室的标牌

正确答案：D。载有本人姓名、职务或者职称的标牌